由于滥用广谱抗生素，使寄生在正常人体某部位的正常菌群，各菌种之间的比例发生了较大幅度的超出正常范围的改变，称为
A. 正常菌群
B. 微生态平衡
C. 机会致病菌
D. 菌群失调
E. 菌群失调症

正确答案：D。菌群失调

解析：菌群失调指寄生在正常人体某部位的正常菌群，各菌种之间的比例发生了较大幅度的超出正常范围的改变，多由滥用广谱抗生素引起。掌握“细菌的分类”知识点。